脑脊液渗入的结构是
A. 软脑膜
B. 脉络丛
C. 蛛网膜粒
D. 海绵窦
E. 无

正确答案：C。蛛网膜粒

解析：软脑膜（A错）薄而富有血管和神经，覆盖于脑的表面并伸入沟裂内；脑脊液经蛛网膜粒（C对）渗入硬脑膜窦内；脉络丛（B错）是产生脑脊液的主要结构；海绵窦（D错）位于蝶鞍两侧，为两层硬脑膜间的不规则腔隙。